四格表资料两样本率比较的χ²检验，错误的一项为
A. χ²值为两样本率比较中Z值的平方
B. χ²值越大，越有理由拒绝H₀
C. χ²值大小与样本含量有关
D. 每个格子的理论频数与实际频数的差的绝对值相等
E. 每个格子的理论频数与实际频数的差的绝对值不一定相等

正确答案：E。每个格子的理论频数与实际频数的差的绝对值不一定相等